人的社会化指的是
A. 教育
B. 社会活动
C. 从自然人到社会人的过程
D. 信仰
E. 风俗

正确答案：C。从自然人到社会人的过程